可使老年人发生尿潴留的是
A. 拟胆碱药
B. 解热镇痛药
C. 拟肾上腺素药
D. 抗肾上腺素药
E. 抗胆碱药

正确答案：E。抗胆碱药

解析：本题考查抗胆碱药的不良反应。抗胆碱药（E对）可使老年人发生尿潴留。老年人服用抗胆碱药物引起膀胱括约肌张力增长，膀胱逼尿肌舒张，从而引起尿潴留、麻痹性肠梗阻和急性青光眼，此时可以用拟胆碱药（A错）进行抢救；解热镇痛药（B错）的不良反应为胃肠道反应；拟肾上腺素药（C错）的不良反应为急性肾衰竭。